书写药品要规范，药品用法不可用
A. 中文
B. 英文
C. 自用
D. 缩写体
E. 拉丁文

正确答案：C。自用

解析：书写药品要规范，药品用法可用规范的中文、英文、拉丁文或者缩写体书写，但不得使用“遵医嘱”、“自用”等含糊不清字句。掌握“处方管理概述及一般规定、处方权”知识点。